开展用药调查及药品利用评价是
A. 执业药师的责任
B. 执业药师的权力
C. 执业药师的义务
D. 执业药师的权利
E. 执业药师的执业行为规范

正确答案：A。执业药师的责任

解析：本题考查执业药师的责任。开展用药调查及药品利用评价是执业药师的责任（A对）。执业药师的主要职责是保障药品质量与指导合理用药。《执业药师资格制度暂行规定》（人发[1999]34号）中明确了执业药师具体职责：①执业药师必须遵守职业道德，忠于职守，以对药品质量负责、保证公众用药安全有效为基本准则；②执业药师必须严格执行《药品管理法》及国家有关药品研制、生产、经营、使用的各项法规及政策，对违反《药品管理法》及有关法规的行为或决定，有责任提出劝告、制止、拒绝执行并向上级报告。③执业药师在执业范围内负责对药品质量的监督和管理，参与制定、实施药品全面质量管理及对本单位违反规定的处理；④执业药师负责处方的审核及监督调配，提供用药咨询与信息，指导合理用药，开展治疗药物的监测及药品疗效的评价等临床药学工作。执业药师的权力（B错）包括：1、执业药师全权负责药品质量和药学服务质量管理工作；2、执业药师有权审核、监督医师的处方。对配伍禁忌或超剂量的处方，以及危及用药安全、有效、合理的处方，有权拒绝调配；3、在保证药品质量和疗效等同，并且在购药者要求或同意的情况下，执业药师有权以更经济的其它商品名的该种药品进行替换，但国家特殊管理的药品和处方药除外；4、在患者生命安全存在危险的特殊情况下，执业药师有权紧急提供处方药品，但事后必须如实记录，并立即向执业药师管理机构报告说明情况；5、在没有医疗机构的地方，或者说在没有执业医师时的紧急救灾、救护的情况下，执业药师有权提供处方药品；6、执业药师有权根据医师的诊断和医嘱向长期服用某种处方药品的慢性病患者提供该种处方药品；7、执业药师有权指导、监督和管理其技术助理的处方调配、销售或供应过程。对于不正确的处方药调配、销售或供应，执业药师有权给予纠正；8、执业药师有权拒绝明显导致危害用药者生命健康、违反社会伦理道德的售药要求。9、执业药师有权否定危及安全、有效、合理用药方案；10、执业药师有权否定危及药品质量的购进品种、购进渠道、管理药品储存过程；11、执业药师有权依法签署有关药学业务文件；12、执业药师有权选择接受继续教育的选修、自修内容及其形式和时间。在各国制定的药师道德准则中，药师的义务（C错）应包括：①合理、公平地分配现有的健康资源；②保证服务对象的安全、健康和最大利益，并以诚相待；③与其他卫生工作人员合作，确保向患者和社会提供可能的最佳卫生保健质量。执业药师的权利（D错）包括：1、任何组织和个人都应该尊重执业药师。执业药师人格尊严和人身安全受到保护；2、执业药师有权备用执业所需的药学专业手册和相关法律手册，订阅执业所需的杂志；3、执业药师可以并且应该依法组织自律性协会组织，参加协会组织的药学技术业务等活动，接受协会组织依法进行的自律性管理；4、执业药师有权参加旨在提高药学专业、法律素质的各种形式的继续教育；5、执业药师有权依法进行科学研究、新产品、新技术开发和学术交流；6、执业药师有权争取并获得正当、合理的执业报酬；7、执业药师有权向执业药师管理机构投诉侵害其权利的行为；8、执业药师有权就执业药师管理机构对自己作出的处罚提出质疑，要求更正、或依法申请行政复议及行政诉讼；9、对于技术精湛、行为高尚、贡献突出的执业药师应受到有关方面的表彰和奖励。执业药师的执业行为规范（E错）包括：1、维护病患者和公众的健康利益。2、按规定进行注册、参加继续教育，依法在合法的单位从事合法的药学技术业务活动。3、提供各类用药咨询。4、对其调配的药品及其他职责范围内的关键药学技术业务负责，不得将其职责范围内的关键药学技术工作交由其助实习生等非执业药师人员单独进行。5、对于在执业过程中知晓的他人的秘密，不得无故泄露。